通常后牙铸造金属全冠龈边缘的最佳选择是
A. 龈上凹形边缘
B. 龈下肩台边缘
C. 龈上肩台边缘
D. 龈下凹形边缘
E. 平龈边缘

正确答案：A。龈上凹形边缘

解析：本题考查后牙铸造金属全冠龈边缘的设计。通常后牙铸造金属全冠龈边缘的最佳选择是龈上凹形边缘（A对）。后牙修复强调功能，兼顾美观，设计龈上边缘（BDE错）即可，既不损伤龈组织，也便与检查和磨改修复体的边缘，使它们更加密合，并能减少或消除对龈组织的刺激。龈上凹形边缘肩台宽度为0.5mm，深凹槽和肩台边缘宽度为1mm（BC错），对于铸造金属全冠来说，0.5mm足够容纳铸造金属全冠的边缘，保证金属全冠边缘足够的强度，无需多磨除牙体组织。